慢性复发性腮腺炎腮腺造影X线表现为
A. 导管移位，腺体内有充盈缺损
B. 造影剂外溢呈团块状
C. 导管中断，或圆形、卵圆形充盈缺损，其远心端导管扩张
D. 导管系统无异常改变或轻微扩张，末梢导管扩张呈点状、球状
E. 只有主导管分层状改变，没有末梢导管扩张

正确答案：D。导管系统无异常改变或轻微扩张，末梢导管扩张呈点状、球状

解析：慢性复发性腮腺炎：可发生于儿童或成人，多自儿童期发病，到青春期后仍未痊愈，则成为成人复发性腮腺炎。腮腺造影表现为主导管无异常改变或表现为轻度扩张；分支导管稀少；末梢导管呈点状、球状、腔状扩张；排空功能迟缓。病变可累及副腺体。随着年龄增长，临床发作次数减少，末梢导管扩张数目也逐渐减少，直至完全消失。下颌下腺未见明显影像学异常。掌握“慢性复发性腮腺炎”知识点。